患儿哮喘缓解后，仍见面色㿠白，气短懒言，语声低微，自汗怕冷，四肢不温。其证候是
A. 肺肾阴虚
B. 肺脾气虚
C. 肾虚不纳
D. 热性哮喘
E. 寒性哮喘

正确答案：B。肺脾气虚

解析：哮喘是一种反复发作的哮鸣气喘疾病。肺脾气虚证表现为反复感冒，气短自汗，咳嗽无力，形体消瘦，神疲懒言，面白少华或萎黄，纳差，便溏，舌质淡胖，苔薄白，脉细软，指纹淡（B对）。肺肾阴虚证证候：喘促乏力，动则气喘，干咳少痰，痰黏难咯，咳嗽无力，盗汗，形体消瘦，腰膝酸软，面色潮红，午后潮热，口咽干燥，手足心热，便秘，舌红少津，苔花剥，脉细数，指纹淡红（A错）。肾虚不纳应见形寒怯冷，下肢不温，脚软无力，动则心悸气促，大便澄清，或夜间遗尿（C错）。热性哮喘可见咳嗽喘急，声高息涌，咳痰稠黄，身热咽红（D错）。寒性哮喘表现为喘咳气促、喉间哮鸣痰吼、恶寒无汗、鼻流清涕等（E错）。